《素问·评热病论》中“劳风”的病变部位是
A. 心
B. 脾
C. 肾
D. 胃
E. 肺

正确答案：E。肺

解析：劳风是因过劳体虚，感受风寒所致，因卫阳被遏，肺失宣降，郁而化热，灼津炼痰，以致痰热壅肺，其主要症状为恶风振寒，项强而视物不清，咳出青黄涕、其状如脓等，其病位在肺（E对）。